患者，男，24岁，上大学前一直在河北沧州居住，因上前牙有黄黑斑块要求治疗。检查：11，12，21，22唇面有黄褐色斑块，无缺损，表面光滑，质硬，叩（-），冷（-），乡亲中亦有相似情况。医师最可能的诊断是
A. 浅龋
B. 氟斑牙
C. 四环素牙
D. 釉质发育不全
E. 静止龋

正确答案：B。氟斑牙

解析：氟牙症临床表现的特点是在同一时期萌出的釉质上有白垩色到褐色的斑块。严重者还并发有釉质的实质缺损。根据临床表现及乡亲中亦有相似情况，最应考虑的是氟斑牙。氟斑牙是发育时期，在高氟区生活影响牙的发育。前牙最先受影响，若在此之后搬出高氟区，就可能只有前牙受影响。掌握“氟牙症”知识点。